甲状腺功能亢进症的甲状腺病变最常见的是
A. 甲状腺腺瘤
B. 甲状腺腺癌
C. 亚急性甲状腺炎
D. 弥漫性甲状腺肿
E. 结节性甲状腺肿

正确答案：D。弥漫性甲状腺肿

解析：甲状腺功能亢进症是指甲状腺腺体本身产生甲状腺激素过多而引起的甲状腺毒症，其中最常见的病因是弥漫性毒性甲状腺肿（即Graves病）（D对）；多结节性毒性甲状腺肿（E错）、甲状腺自主高功能腺瘤（A错）、桥本甲亢（即亚急性甲状腺炎）（C错）也是引起甲亢的常见病因。甲状腺腺癌（B错）通常表现为甲状腺结节，多数患者无明显临床症状，仅在体检中偶然发现，少数患者以颈部淋巴结肿大或远处转移癌为首发表现，与甲亢无关。